乳房手术作放射状切口的目的是
A. 不影响美观
B. 有利于伤口愈合并减少瘢痕形成
C. 减少损伤乳腺小叶和输乳管
D. 减少损伤乳房悬韧带
E. 无

正确答案：C。减少损伤乳腺小叶和输乳管

解析：减少损伤乳腺小叶和输乳管（C对）是做乳房手术作放射切口的目的。